大柴胡汤中配伍黄芩的用意是
A. 和解清热
B. 清热燥湿
C. 清热止血
D. 清热安胎
E. 凉血解毒

正确答案：A。和解清热

解析：本题考查大柴胡汤的方解，属理解内容。方中重用柴胡为君药，配臣药黄芩和解清热（A对），以除少阳之邪。大柴胡汤主治，少阳阳明合病。柴胡和黄芩配伍来自小柴胡汤，除少阳之热。